人参皂苷二醇型的苷元类型是
A. 齐墩果酸型
B. 乌苏酸型
C. 羽扇豆烷型
D. 羊毛甾烷型
E. 达玛烷型

正确答案：E。达玛烷型

解析：本题考查的是三萜类化合物的分类。人参皂苷二醇型的苷元类型是达玛烷型（E对）。三萜：基本骨架由6个异戊二烯单位组成。三萜的种类很多，但以皂苷形式存在的三萜类型并不多，较为常见的有羊毛甾烷型、达玛烷型、齐墩果烷型、乌苏烷型和羽扇豆烷型，其中前两种属于四环三萜，后三种则属于五环三萜。1.四环三萜：结构与甾醇很类似。主要有以下类型。（1）羊毛甾烷型（D错），如猪苓酸A。（2）达玛烷型，如20（S）-原人参二醇。2.五环三萜：主要有以下类型。（1）齐墩果烷型（A错），此类以齐墩果酸最为多见。（2）乌苏烷型（B错），此类大多是乌苏酸的衍生物。（3）羽扇豆烷型（C错），如羽扇豆种子中存在的羽扇豆醇，酸枣仁中分得的白桦醇和白桦酸等。